COPD患者的肺功能检查主要表现为
A. 支气管舒张试验阳性
B. 弥散功能下降
C. FEV1/FVC下降
D. 残气量下降
E. 肺总量下降

正确答案：C。FEV1/FVC下降

解析：COPD的特点是一种持续存在的呼吸系统症状和气流受限，它的主要客观指标是肺功能检查，判断持续气流受限的标准是吸入支气管扩张剂后，FEV1/FVC<70%，肺总量(TLC)、功能残气量(FRC)和残气量（RV)增高，肺活量(VC)减低（C对DE错）。支气管舒张试验属于支气管哮喘的实验室检查方法（A错），间质性肺疾病时会出现限制性通气功能障碍同时伴有弥散功能的降低（B错）。